外源化学物经皮肤途径吸收主要通过
A. 主动转运
B. 简单扩散
C. 滤过
D. 载体扩散
E. 吞噬作用

正确答案：B。简单扩散